男，68岁。半年来每天排便4～5次，便中带血及黏液。突发腹胀、停止排气排便2天。查体：T37.2℃。全腹轻微压痛，左侧腹部平脐可触及包块，腹部叩诊鼓音，肠鸣音6～7次/分，直肠指诊未触及肿物。实验室检查：H90g/L，WBC6.7×10⁹/L。X线透视全腹多个气液平。最可能的诊断是
A. 结肠肝曲癌
B. 降结肠癌
C. 升结肠癌
D. 横结肠癌
E. 结肠脾曲癌

正确答案：B。降结肠癌

解析：老年患者，便频、血便，停止排气排便、X线示气液平（肠梗阻症状），左侧腹部包块，符合左侧结肠癌典型临床表现，结合患者病史及相关检查，最可能的诊断是降结肠癌（B对）。结肠肝曲癌（A错）包块位于右上腹。升结肠癌（C错）位于右侧腹部。横结肠癌（D错）见于上腹部。结肠脾曲癌（E错）位于左上腹。